男，69岁。右上腹剧烈疼痛2天，黄疸，发热1天。首选检查是
A. 腹部B超
B. 腹部X线平片
C. 磁共振胰胆管成像
D. 腹部CT
E. 经内镜逆行胰胆管造影

正确答案：A。腹部B超

解析：老年患者，腹痛、寒战高热、黄疸（Charcot三联征，胆管炎典型表现），根据临床表现及查体，应考虑急性胆管炎，临床上以胆总管结石引起者最多见。腹部B超是胆系疾病的首选检查方法，可发现结石并明确大小和部位，故应首选腹部B超（A对）。除钙盐含量较多，对于一般的结石，腹部X线平片难以显影，腹部X线平片（B错）对本病的诊断价值不大。磁共振胆胰管成像（C错）、腹部CT（D错），可发现胆道扩张及梗阻部位，但价格昂贵、操作复杂，一般不作为首选。经内镜逆行胰胆管造影（E错）为有创检查方法，会带来一定的并发症，不作为首选。